下列不属于促进健康的行为是
A. 积极的休息和睡眠
B. 体育锻炼
C. 饮酒
D. 心理平衡
E. 合理营养和平衡膳食

正确答案：C。饮酒